枸橼酸铋钾服后可能导致
A. 黑色大便
B. 口干和视力模糊
C. 便秘
D. 幻觉、定向力障碍
E. 疲乏、嗜睡

正确答案：A。黑色大便

解析：本题考查枸橼酸铋钾的不良反应。枸橼酸铋钾主要不良反应是黑便（A对），大量长期服用可有脑、肾毒性。